可用于除去溶剂中热原的方法有
A. 吸附法
B. 超滤法
C. 渗透法
D. 离子交换法
E. 凝胶过滤法

正确答案：A、B、D、E。吸附法；超滤法；离子交换法；凝胶过滤法

解析：本题考查除去溶剂中热原的方法。除去药液或溶剂中热原的方法：①吸附法（A对）：活性炭是常用的吸附剂，用量一般为溶液体积的0.1%～0.5%。活性炭的吸附作用强，除了吸附热原外，还有脱色、助滤作用。②离子交换法（D对）：热原分子上含有磷酸根与羧酸根，带有负电荷，因而可以被弱酸性阳离子交换树脂吸附。③凝胶滤过法（E对）：也称分子筛滤过法，是利用凝胶物质作为滤过介质，当溶液通过凝胶柱时，分子量较小的成分渗入到凝胶颗粒内部而被阻滞，分子量较大的成分则沿凝胶颗粒间隙随溶剂流出。例如用二乙氨基乙基葡聚糖凝胶（分子筛）制备无热原去离子水。④超滤法（B对）：一般用3～15nm超滤膜除去热原。本法利用高分子薄膜的选择性与渗透性，在常温条件下，依靠一定的压力和流速，达到除去溶液中热原的目的。⑤反渗透法（C错）：本法通过三醋酸纤维素为膜或聚酰胺膜除去热原，是较新发展起来的效果好、具有较高的实用价值的方法。⑥其他方法：采用两次以上湿热灭菌法，或适当提高灭菌温度和时间，处理含有热原的葡萄糖或甘露醇注射液亦能得到热原合格的产品。微波也可破坏热原。